适用于弱酸、稀酸、碱类和普通溶剂滤过的是
A. 醋酸纤维素膜
B. 硝酸纤维素膜
C. 聚酰胺膜
D. 聚四氟乙烯膜
E. 聚偏氟乙烯膜

正确答案：C。聚酰胺膜